下列各项，与肺主通调水道功能关系最密切的是
A. 气机的调节
B. 朝百脉
C. 主宣发与肃降
D. 司呼吸
E. 宗气的生成

正确答案：C。主宣发与肃降

解析：本题考查肺的主要生理机能，属于理解记忆内容。肺气的宣发肃降作用推动和调节全身水液的输布和排泄。肺气的宣发作用，能向上向外布散气与津液，肺气的肃降作用，能向内向下布散气和津液，肺气的宣发和肃降，是相互制约、相互为用的两个方面。宣发与肃降协调，则呼吸均匀通畅，水液得以正常的输布代谢，所谓“水精四布，五经并行”。宣发与肃降失调，则见呼吸失常和水液代谢障碍，故与肺主通调水道功能关系最密切的是肺主宣发与肃降（C对）。